心肌损伤的心电图改变是
A. ST段下移
B. ST段明显上抬，呈弓背向上的单向曲线
C. T波高耸
D. T波倒置
E. 异常深而宽的Q波

正确答案：B。ST段明显上抬，呈弓背向上的单向曲线

解析：冠状动脉发生闭塞后，随着时间的推移在心电图上可先后出现心肌缺血、损伤、坏死3种改变。冠状动脉发生闭塞后，最先出现心肌缺血的心电图改变，表现为T波高耸（C错）、ST段下移（A错）、T波倒置（D错）、QT间期延长；随着缺血时间延长，缺血程度进一步加重，出现心肌损伤的心电图改变，表现为ST段明显上抬，呈弓背向上的单向曲线（B对）、上斜型抬高、凹面向上型抬高等；更进一步的缺血导致心肌坏死，心肌坏死的心电图改变为异常深而宽的Q波（E错）或QS波。